患者结婚6年不孕,形体肥胖,经行后期,带下量多,色白黏无臭,胸闷纳差,嗜睡无力,肢体多毛,舌淡胖苔白腻,脉濡滑。其证属
A. 瘀滞胞宫
B. 肝气郁结
C. 肾气虚
D. 痰湿内阻
E. 肾阳虚

正确答案：D。痰湿内阻

解析：题干中患者结婚6年不孕,形体肥胖,经行后期,带下量多,色白黏无臭,胸闷纳差,嗜睡无力,肢体多毛,舌淡胖苔白腻,脉濡滑符合不孕证痰湿内阻证（D对）。不孕瘀阻胞宫证表现婚久不孕，月经多推后或周期正常，经来腹痛，甚则进行性加重，经色紫黯有血块，舌质紫黯，舌边有瘀点（A错）。不孕肝气郁结证表现婚久不孕，月经或先或后，经量多少不一，经前烦躁易怒，胸胁乳房胀痛，善太息，脉弦细（B错）。不孕肾气虚表现婚久不孕，月经不调或停闭，头晕耳鸣，腰膝酸软，精神疲倦，小便清长脉沉细，两尺脉弱（C错）。不孕肾阳虚表现婚久不孕，月经迟发或月经推后，经色淡黯，小腹冷，带下量多清晰如水头晕耳鸣，腰膝酸软，夜尿多脉沉细尺弱（E错）。